肥达试验检测病人体内哪种物质的有无及其含量
A. 血清中抗原
B. 血清中抗体
C. 大便中细菌
D. 尿液中细菌
E. 胆汁中细菌

正确答案：B。血清中抗体